慢性病自我管理的三大特征是
A. 医疗和行为管理、情绪管理、时间管理
B. 情绪管理、角色管理、时间管理
C. 医疗和行为管理、情绪管理、角色管理
D. 费用管理、情绪管理、时间管理
E. 医疗和行为管理、情绪管理、费用管理

正确答案：C。医疗和行为管理、情绪管理、角色管理

解析：慢性病自我管理是指在卫生保健专业人员的协助下，个人承担一些预防性或治疗性的卫生保健活动。其三大自我管理任务分别是所患疾病的医疗和行为管理、角色管理和情绪管理（C对）。时间管理是针对冠心病的危险行为矫正的方法（ABD错）。费用管理一般出现在药物控制管理中（E错）。